病变处做涂片检查，可见PAS染色强阳性，呈玫瑰红色的孢子，可以诊断为
A. 多形性红斑
B. 扁平苔藓
C. 慢性盘状红斑狼疮
D. 念珠菌病
E. 疱疹性口炎

正确答案：D。念珠菌病

解析：念珠菌病病变处涂片检查，并进行PAS染色，可以发现真菌及孢子为强阳性，呈玫瑰红色。掌握“口腔念珠菌病与肉芽肿性唇炎”知识点。